头部外伤后慢性硬脑膜下血肿的时限，定义为
A. 3天内
B. 1周内
C. 3天～3周内
D. 3周以后
E. 1年以后

正确答案：D。3周以后

解析：硬脑膜下血肿根据症状出现的时间可分为急性、亚急性和慢性三种，其中慢性硬脑膜下血肿指头部外伤后3周（D对）才出现症状的硬膜下血肿。3天～3周（C错）内出现症状为亚急性硬脑膜下血肿；3天内（A错）出现症状为急性硬脑膜下血肿。